钟状期的成釉器由几层细胞构成
A. 2
B. 3
C. 4
D. 5
E. 以上都不对

正确答案：C。4

解析：钟状期：帽状期成釉器不断增大，基底部的凹陷加深，形似吊钟，称为钟状期成釉器。此期凹陷面的形态已确定，在前牙为切牙牙冠的形态；在后牙为磨牙牙冠的形态。此期成釉器的细胞分化为四层：内釉上皮、星网状层、外釉上皮、中间层。掌握“牙胚的发生及分化”知识点。